关于—块典型椎骨，哪一种说法有误
A. 有一个棘突
B. 有一对椎孔
C. 有两对关节突
D. 有一对椎弓根
E. 有一对横突

正确答案：B。有一对椎孔

解析：典型椎骨只有一个椎孔，各椎孔上下贯通，构成容纳脊髓的椎管（B错，为本题正确答案）。典型椎骨有一个棘突（A对），一对椎弓根（D对），有两对关节突（C对）和一对横突（E对）。